药学信息按照其来源通常分为三级。属于三级信息资源的是
A. 期刊发表的病例报告
B. 期刊发表的实验研究结果
C. 临床实践指南
D. 文摘数据库
E. 全文数据库

正确答案：C。临床实践指南

解析：本题考查药物信息的分类。属于三级信息资源的是临床实践指南（C对）。药物信息按照其最初来源通常分为三级，即以期刊发表的原创性论著为主的一级信息源、引文和摘要服务为主的二级信息源以及参考书和数据库为主的三级信息源。一级信息资源即原创性论著，包括实验研究结果（B错）、病例报道（A错）以及评价性或描述性的研究结果。二级信息资源一般由引文、书目组成，文摘数据库（D错）或全文数据库（E错）是常用二级信息资源。三级信息资源指从原创性研究中提取出被广泛接受的数据信息，对之进行评估而发表的结果，包括医药图书（工具书、教科书、手册等）、光盘或在线数据库、药学应用软件以及临床实践指南、系统评价或综述型文章等。